从下列各结构中，选出不属于右心房内的结构
A. 卵圆窝
B. 肺静脉口
C. 下腔静脉口
D. 上腔静脉口
E. 梳状肌

正确答案：B。肺静脉口

解析：肺静脉口（B错，为本题正确答案）位于左心房内，其后壁两侧各有一对肺静脉开口，不属于右心房内的结构。